女性，28岁，因最近时常健忘前来就诊，使用CT拍摄颅脑部位，发现占位性病变，根据症状，可大概推断脑部的发病部位为
A. 额叶
B. 顶叶
C. 海马回
D. 垂体
E. 脑干

正确答案：A。额叶

解析：颅内肿瘤发生精神症状：主要是人格改变和记忆力减退，最常见于额叶肿瘤。掌握“颅内肿瘤”知识点。